下列哪项不能传播AIDS
A. 性接触
B. 输血
C. 母婴传播
D. 器官移植
E. 蚊虫叮咬

正确答案：E。蚊虫叮咬

解析：HIV不能在蚊虫体内复制，且蚊虫口器沾染的病毒量极少，蚊虫叮咬（E错，为本题正确答案）不会传播艾滋病；艾滋病传播途径包括；性接触（A对）、体液传播，输血（B对）属于体液传播、母婴传播（C对），器官移植（D对）过程中会有血液接触可能发生感染。